患儿，1岁。发热3天，频繁呕吐1天，伴惊厥3次。查体：精神委靡，前囟1cm×1cm隆起，颈项强直布氏征（+），脑脊液外观混浊，白细胞3.0×10⁹/L，多核0.8，蛋白300mg/L，糖1.4mmol/L。最可能的诊断是
A. 化脓性脑膜炎
B. 结核性脑膜炎
C. 病毒性脑膜炎
D. 新型隐球菌性脑膜炎
E. 瑞氏综合征

正确答案：A。化脓性脑膜炎

解析：根据本题患儿起病急，起病前有上呼吸道感染病史，有精神萎靡，频繁呕吐1天伴惊厥的临床表现，以及颈项强直，布氏征阳性，脑脊液外观浑浊，白细胞3.0×10⁹/L（<5.0×10⁹/L），多核0.8，可诊断急性化脓性脑膜炎（A对）；结核性脑膜炎除婴儿外，一般起病较缓，常有结核接触史及其他部位结核病灶。PPD 检查阳性有重要参考价值。脑脊液外观呈毛玻璃状，白细胞数多<500×10⁶L，偶尔超过1000×10⁶L，以淋巴细胞为主，糖及氯化物明显减低，蛋白增高达1～3g/L，涂片抗酸染色和结核菌培养可帮助确定诊断（B错）；病毒性脑膜炎临床表现与化脑相似，全身感染中毒及神经系统症状较轻。脑脊液外观清亮，白细胞数 0～数百 ×10⁶/L，以淋巴细胞为主，蛋白轻度增高，糖、氯化物正常，细菌学检查阴性，脑脊液中病毒特异性抗体和病毒分离有助诊断（C错）；隐球菌性脑膜炎是由新型隐球菌感染脑膜和（或）脑实质所致，临床表现为间歇性头痛、恶心、呕吐、低热、周身不适等（D错）；瑞氏综合征可能因病毒感染、药物、毒素、遗传等因素所致，主要表现为频繁呕吐、腹泻、疲倦，加重后可出现神志不清、癫痫，甚至昏迷（E错）。